母乳中含量高于牛乳的成分是
A. 乳清蛋白
B. 酪蛋白
C. 钙
D. 铁
E. 磷

正确答案：A。乳清蛋白

解析：本题考查母乳中含量高于牛乳的成分。母乳中含量高于牛乳的成分是乳清蛋白（A对BCDE错）。